蛋白质分子中的氨基酸残基可被PKC磷酸化的是
A. 酪氨酸/丝氨酸
B. 丝氨酸/苏氨酸
C. 酪氨酸/苏氨酸
D. 丝氨酸/组氨酸
E. 苏氨酸/组氨酸

正确答案：B。丝氨酸/苏氨酸

解析：蛋白激酶（P386）是催化ATP的γ-磷酸基转移至靶蛋白的特定氨基酸残基上的一类酶，蛋白质分子中的氨基酸残基可被PKC磷酸化的是丝氨酸/苏氨酸（B对），因此PKC属于蛋白丝氨酸/苏氨酸激酶。